可显著抑制复极化，延长动作电位时程和有效不应期的药物是
A. 胺碘酮
B. 普鲁卡因
C. 普萘洛尔
D. 利多卡因
E. 维拉帕米

正确答案：A。胺碘酮

解析：本题考查胺碘酮。胺碘酮（A对）为延长动作电位时程药，通过阻断介导复极的钾通道而延长心脏动作电位时程，增加心肌不应期，消除折返。适用于阵发性室上性心动过速、阵发心房扑动、心房颤动。普鲁卡因胺（B错）属于Ⅰa类抗心律失常药，适用于危及生命的室性心律失常。普萘洛尔（C错）是β受体阻断剂，主要用于治疗室上性心律失常。利多卡因（D错）属于Ib类抗心律失常药，仅用于室性心律失常。维拉帕米（E错）为钙通道阻滞剂，临床用于心绞痛、室上性心律失常，原发性高血压。